阿托品中毒的瞳孔变化是
A. 瞳孔扩大
B. 瞳孔缩小
C. 瞳孔呈白色
D. 两瞳孔大小不等
E. 瞳孔形状不规则

正确答案：A。瞳孔扩大

解析：阿托品中毒的瞳孔变化是瞳孔扩大（A对E错）。瞳孔扩大见于外伤、颈交感神经刺激、青光眼绝对期、视神经萎缩、阿托品、可卡因等药物影响等。瞳孔缩小见于虹膜炎症、有机磷中毒、毛果云香碱反应等（B错）。瞳孔呈白色见于视网膜母细胞瘤、永久性原始玻璃体增生症等（C错）。两瞳孔大小不等见于脑外伤、脑肿瘤、中枢神经梅毒、脑疝等（D错）。